女，60岁。反复咳嗽、咳脓痰、咯血30年，再发伴发热3天。近3天来静脉滴注“头孢菌素”，仍有较多脓痰及痰中带血。查体：T37.5℃，左下肺可闻及湿啰音，杵状指。该患者最可能的诊断是
A. 支气管扩张
B. 支气管肺癌
C. 肺结核
D. 慢性支气管炎
E. 肺脓肿

正确答案：A。支气管扩张

解析：患者为老年女性，反复咳嗽、咳脓痰、咯血（为支气管扩张的典型表现），有杵状指（为支气管扩张的重要表现），发热3天，有较多脓痰及痰中带血提示伴发肺部感染，故最可能的诊断为支气管扩张（A对）。支气管肺癌（P77）（B错）常多为无痰或少痰的刺激性干咳，不会有反复咳嗽咳脓痰咯血30年的病史。肺结核（P65）（C错）咳嗽较轻，干咳或少量粘液，有全身症状午后低热和盗汗等结核中毒症状。慢性支气管炎（P19-P20）（D错）缓慢起病，病程长，反复急性发作而病情加重，主要症状为咳嗽、咳痰或伴有喘息，无咯血症状。肺脓肿（P58）（E错）急性起病，高热，体温达39～40℃，伴有咳嗽、咳黏液痰或黏液脓性痰，且炎症累及壁层胸膜可引起与呼吸有关的胸痛，此外还有精神不振、全身乏力、食欲减退等全身中毒症状。